男，45岁，1个月前出现腹胀，无呕吐，伴发热，体温最高38℃，夜间盗汗，12小时前突发腹部绞痛，未排气排便，查体：T37.7℃，P88次/分，R16次/分，BP110/80mmHg，心肺查体未见异常，腹部呈揉面感，可见肠型及蠕动波，肠鸣音亢进。该患者最可能的诊断是
A. 淋巴瘤并肠梗阻
B. 家族性息肉病
C. 溃疡性结肠炎
D. 结肠癌并肠梗阻
E. 结核性腹膜炎并肠梗阻

正确答案：E。结核性腹膜炎并肠梗阻

解析：患者为青壮年男性，1个月前出现腹胀伴发热和夜间盗汗，腹部呈揉面感，提示结核性腹膜炎；患者12小时前突发腹部绞痛，未排气排便，可见肠型及蠕动波，肠鸣音亢进，提示并发肠梗阻（E对）。淋巴瘤可出现腹胀、发热、盗汗的表现，但体检可发现腹部肿块，质地较硬，而无揉面感（A错）。家族性息肉病是一种常染色体显性遗传性疾病，好发于青年，常见的临床表现是便血、腹泻，有时可有腹痛、粘液便（B错）。溃疡性结肠炎的主要症状表现为腹痛和黏液脓血便，常有里急后重，排便后缓解（C错）。结肠癌也可表现为腹胀、发热、盗汗，但结肠癌以排便习惯和粪便性状的改变为最初表现，腹部触诊可触及腹部坚硬肿块（D错）。